性微寒，既降气祛痰，又宣散风热的药是
A. 白前
B. 百部
C. 前胡
D. 芥子
E. 洋金花

正确答案：C。前胡

解析：本题考查的是前胡的功效。性微寒，既降气祛痰，又宣散风热的药是前胡（C对）。前胡：【功效】降气祛痰，宣散风热。白前（A错）：【功效】降气祛痰止咳。百部（B错）：【功效】润肺止咳，杀虫灭虱。芥子（D错）：【功效】温肺祛痰，利气散结，通络止痛。洋金花（E错）：【功效】平喘止咳，解痉，定痛。